孕妇接触可引起女儿阴道癌的是
A. 己烯雌酚
B. 2-萘胺
C. 黄曲霉毒素B₁
D. 砷及其化合物
E. 双氯甲醚

正确答案：A。己烯雌酚

解析：本题考查孕期保健的注意事项。在妊娠期给药己烯雌酚（A对BCDE错），会造成女胎青春期患阴道腺病，发生阴道癌；男胎女性化，睾丸发育不全。